可用普萘洛尔解救的是
A. 阿片类药物中毒
B. 克伦特罗（瘦肉精）中毒
C. 有机磷中毒
D. 华法林所致中毒
E. 甲基苯丙胺（冰毒）中毒

正确答案：B。克伦特罗（瘦肉精）中毒

解析：本题考查瘦肉精中毒的解救。瘦肉精（药品通用名为“克仑特罗”）属强效β₂受体激动剂。轻度中毒，停止饮食，平卧，多饮水，静卧后可好转。重度中毒（B对），催吐、洗胃、导泻；监测血钾，适量补钾；口服或静脉滴注β受体阻断剂如普萘洛尔、美托洛尔、艾司洛尔等。